病原为真核细胞型微生物的疾病
A. 传染性单核细胞增多症
B. 水痘
C. 结核
D. 霍乱
E. 鹅口疮

正确答案：E。鹅口疮

解析：病原为真核细胞型微生物的疾病是鹅口疮（E对），鹅口疮是白假丝酵母菌感染黏膜所致，白假丝酵母菌为真菌，是真核细胞型微生物。传染性单核细胞增多症（A错）的病原体是EB病毒（EBV），EB病毒为非细胞型微生物（P300）。水痘（B错）的病原体虱水痘-带状疱疹病毒（VZV），水痘-带状疱疹病毒为非细胞型微生物（P927）。结核（C错）的病原体是结核分枝杆菌，结核分枝杆菌是原核细胞型微生物（P141）。霍乱（D错）的病原体是霍乱弧菌，霍乱弧菌是原核细胞型微生物（P124）。